生物药剂学研究的广义剂型因素不包括
A. 药物的化学性质
B. 药物的物理性状
C. 药物的剂型及用药方法
D. 制剂的工艺过程
E. 种族差异

正确答案：E。种族差异

解析：本题考查影响药物吸收的因素。种族差异（E错，为本题正确答案）属于机体方面对药物作用影响的因素；影响药物吸收的剂型（广义）因素包括：1.影响药物吸收的物理化学因素（AB对）；2.剂型与剂型因素对药物吸收的影响（CD对）。